应用1：5000～1：2000高锰酸钾溶液洗胃可以解救
A. 巴比妥类药物中毒
B. 阿片类药物中毒
C. 毒扁豆碱中毒
D. 磷化物中毒
E. 农药乐果中毒

正确答案：A、B、C、D。巴比妥类药物中毒；阿片类药物中毒；毒扁豆碱中毒；磷化物中毒

解析：本题考查中毒解救。1：2000～5000高锰酸钾溶液为氧化剂，可破坏生物碱及有机物，常用于巴比妥类（A对）、阿片类（B对）、士的宁、烟碱、奎宁、毒扁豆碱（C对）及砷化物、氰化物、无机磷（D对）等药物中毒。农药乐果中毒（E错）时禁用1：5000～1：2000高锰酸钾溶液洗胃。